男性，46岁，因反复出现头晕，鼻出血3年就诊。有疟疾病史。查体：巩膜无黄染，肝未触及，脾左肋下8cm，无腹水征。肝功能正常，骨髓检查：增生骨髓象。食道吞钡透视检查无食道静脉曲张。最有效的治疗方法是
A. 应用补血药
B. 用止血药
C. 输注全血
D. 脾切除术
E. 脾切除加门腔分流术

正确答案：D。脾切除术

解析：中年男性患者，有疟疾病史（慢性患者可致脾脏不可逆性肿大）。反复出现头晕（可能存在脑供氧不足），鼻衄（提示凝血功能减退）3年。查体：脾左肋下8cm（脾大超过脐水平线或前正中线称为巨脾，可引起血细胞三系减少），肝未触及，无腹水征，肝功能正常（可排除门脉高压引起的脾大）。骨髓检查：增生骨髓象（提示血细胞生成活跃）。综合该患者的病史、体查及实验室检查，诊断考虑继发性脾功能亢进，最有效的治疗方法是脾切除术（D对）。该患者无失血表现，无需应用补血药（A错）、用止血药（B错）、输注全血（C错）等。脾切除加门腔分流术（E错）主要用于治疗门静脉高压并发食管胃底曲张静脉破裂出血。